非水溶液滴定法使用的滴定液是
A. 氢氧化钠滴定液
B. 硫酸铈滴定液
C. 高氯酸滴定液
D. 碘滴定液
E. 乙二胺四醋酸二钠滴定液

正确答案：C。高氯酸滴定液

解析：本题考查非水溶液滴定法。非水溶液滴定法使用的滴定液是高氯酸滴定液（C对）。非水溶液滴定法分为非水碱量法和非水酸量法，非水碱量法溶剂为冰醋酸或冰醋酸-醋酐，滴定液为高氯酸的冰醋酸溶液。氢氧化钠滴定液（A错）是酸碱滴定法使用的滴定液。硫酸铈滴定液（B错）是铈量法使用的滴定液。碘滴定液（D错）碘量法使用的滴定液。乙二胺四醋酸二钠滴定液（E错）是配位滴定法使用的滴定液。